可发生心脏离心性肥大的疾病是
A. 高血压病
B. 肺源性心脏病
C. 主动脉瓣关闭不全
D. 二尖瓣狭窄
E. 冠心病

正确答案：C。主动脉瓣关闭不全

解析：长期存在心肌损伤或负荷增加时，心室通过慢性综合性适应性反应即心室重塑进行代偿，其中就包括心肌肥大。其根据室壁厚度与心腔半径的关系可分为向心性肥大和离心性肥大。长期过度的后负荷如高血压病（A错）、肺源性心脏病（B错）刺激心肌肌节呈并联性增生，心肌细胞增粗，表现为心室壁显著增厚而心腔容积正常甚或减小，称为向心性肥大。长期过度的前负荷如主动脉瓣关闭不全（C对）刺激心肌肌节呈串联性增生，心肌细胞增长，心腔容积增大，后者又可刺激心肌细胞增粗，室壁增厚，因而表现为心腔容积显著增大并室壁轻度增厚，称为离心性肥大。